外阴鳞状上皮增生局部治疗的主要药物是
A. 雌激素
B. 糖皮质激素
C. 抗病毒药物
D. 雄激素
E. 抗生素

正确答案：B。糖皮质激素

解析：外阴鳞状上皮增生的病因不明，可能与外阴局部潮湿、阴道排出或外来刺激物刺激出现外阴瘙痒而反复搔抓有关，其治疗包括一般治疗、局部药物治疗、物理治疗和手术治疗。局部治疗的目的在于控制局部瘙痒，主要药物是糖皮质激素（B对）。雌激素（A错）用于闭经、无排卵性功血等的治疗。抗病毒药物（C错）主要用于治疗病毒感染。雄激素（D错）可用于无排卵性功血的辅助治疗。抗生素（E错）主要用于治疗细菌感染。